肺所宣发的气是
A. 精气
B. 营气
C. 卫气
D. 宗气
E. 元气

正确答案：C。卫气

解析：该题主要考察肺气宣发肃降的生理功能。肺气宣发主要体现在三个方面：一是呼出体内浊气；二是将脾转输至肺的水谷精微和津液上输头面诸窍，外达皮毛肌滕；三是宣发卫气（C对）于皮毛肌腠，以温分肉，充皮肤，肥腠理，司开阖，并将津液化为汗液排出体外。宗气的生成有两个来源：一是脾胃运化的水谷之精所化生的水谷精气，一是肺从自然界中吸入的清气，两者结合生成宗气故宗气属于后天之气的范畴（D错）。元气指以先天精气为基础，赖后天精气充养，而根源于肾的气（E错）。营气来源于脾胃运化之水谷精微，由水谷精微中的精华部分，即最富营养的部分所化生（B错）。